牛黄解毒丸善清热解毒，治火热内盛，其主治有
A. 咽喉肿痛
B. 牙龈肿痛
C. 肺火咳痰
D. 口舌生疮
E. 目赤肿痛

正确答案：A、B、D、E。咽喉肿痛；牙龈肿痛；口舌生疮；目赤肿痛

解析：本题考查的是牛黄解毒丸的主治。牛黄解毒丸善清热解毒，治火热内盛，其主治有咽喉肿痛（A对）、牙龈肿痛（B对）、口舌生疮（D对）与目赤肿痛（E对）。牛黄解毒丸：【主治】火热内盛所致的咽喉肿痛、牙龈肿痛、口舌生疮、目赤肿痛。主治为肺火咳痰（C错）的中成药，2022年考试指南未明确说明。